进食海产品引起的食物中毒常见的病原体为
A. 副溶血性弧菌
B. 沙门菌
C. 孢霉菌
D. 葡萄球菌
E. 梭状杆菌

正确答案：A。副溶血性弧菌

解析：进食海产品引起的食物中毒常见的病原体为副溶血性弧菌（A对），它存在于近海的海水、海底沉积物、贝壳等海产品中，经烹饪不当的海产品或因食物容器污染本菌后而导致食物中毒。伤寒沙门菌（B错）引起的食物中毒主要由畜、禽肉类食品，其次为蛋类、奶和奶制品导致，系动物生前感染或加工处理过程污染所致（P119）。葡萄球菌（D错）易于引起侵袭性疾病（化脓性感染）及毒素性疾病，其中金黄色葡萄球菌在乳类、肉类食物中极易繁殖，在剩菜剩饭中亦易生长，从而引起食物中毒（P94）。梭状杆菌（E错）主要为厌氧芽胞梭菌，可产生强烈的外毒素，主要引起破伤风、气性坏疽和肉毒中毒等严重疾病，其中肉毒梭菌可导致食物中毒，但原因是食入食品中肉毒梭菌产生的毒素，而非细菌感染（P136）。孢霉菌（C错）属于放线菌，是食用菌生产中易产生污染的杂菌之一，八版医学微生物学未详细说明。